操作简便，重复性好，适合于大规模的口腔流行病学调查的指数是
A. 简化口腔卫生指数
B. Q-H菌斑指数
C. GI
D. SBI
E. CPI

正确答案：E。CPI

解析：社区牙周指数（CPI）1997年口腔健康调查基本方法第4版对社区牙周治疗需要指数作了修改，取名社区牙周指数。这个指数操作简便，重复性好，适合于大规模的口腔流行病学调查。CPI检查内容为牙龈出血、牙石和牙周袋深度。掌握“牙周病流行病学及分级预防”知识点。